男，74岁，反复咳嗽咳痰40年再发加重伴气短2天，查体：口唇发绀，桶状胸，双肺叩诊呈过清音，左上肺呼吸音消失，双下肺散在干湿啰音，心率124次/分，心律不齐。目前除COPD急性加重外，最可能存在的诊断是
A. 肺血栓栓塞
B. ARDS
C. 左心衰竭
D. 阻塞性肺不张
E. 自发性气胸

正确答案：E。自发性气胸

解析：患者为老年男性，反复咳嗽咳痰40年，桶状胸（为慢阻肺典型的症状和体征），双肺叩诊呈过清音，双下肺散在干湿啰音，考虑为慢性阻塞性肺疾病（COPD）。口唇发绀，加重伴气短2天，左上肺呼吸音消失，考虑诊断为COPD伴发自发性气胸（E对）。肺血栓栓塞（P100）（A错）常见症状有不明原因的呼吸困难，胸痛，晕厥，且该患者无血栓易发的高危因素如高血压、高血脂，亦无房颤病史。ARDS（P131）（B错）大多数于原发病起病后72小时内发生，最早出现的症状是呼吸增快，并呈进行性加重的呼吸困难、发绀。左心衰竭（P174-P175）（C错）表现为突发的呼吸困难，双肺底湿啰音，病情严重者可有粉红色泡沫痰，与本病例均不符合。阻塞性肺不张（D错）多有异物吸入史。